根据《中华人民共和国药品管理法》，麻醉药品《进口准许证》的核发部门是
A. 国务院药品监督管理部门
B. 国务院药品监督管理部门会同海关总署
C. 国务院财政部门会同国务院价格主管部门
D. 国务院财政部门会同国务院药品监督管理部门
E. 国务院工商行政管理部门

正确答案：A。国务院药品监督管理部门

解析：本题考查的是药品进口管理与出口管理。根据《中华人民共和国药品管理法》，麻醉药品《进口准许证》的核发部门是国务院药品监督管理部门（A对）。我国公布的药品进出口管理目录有：《进口药品目录》《精神药品管制品种目录》《麻醉药品管制品种目录》和《生物制品目录》。进口、出口麻醉药品和国家规定范围内的精神药品，应当持有国务院药品监督管理部颁发的进口准许证、出口准许证。对列入《进口药品目录》中的药品的进口以及列入《精神药品管制品种目录》《麻醉药品管制品种目录》中的药品的进出口必须经由北京市、天津市、上海市等24个允许药品进口的口岸通关，对列入《生物制品目录》以及首次在中国境内销售的药品必须经由北京市、上海市和广州市3个口岸城市指定的口岸进口。2019年12月，国家药品监督管理局制定了《首次药品进口口岸评估标准》，口岸药品监督管理部门可根据药品进口需求，向国家药品监督管理局提出首次药品进口口岸申请。